患者，女，22岁。月经不调，常提前7天以上，甚至10余日一行。治疗应首选
A. 足三里、脾俞、太冲
B. 命门、三阴交、足三里
C. 关元、三阴交、血海
D. 气海、三阴交、归来
E. 关元、三阴交、肝俞

正确答案：C。关元、三阴交、血海

解析：该患者以月经不调，常提前7天以上，甚至10余日一行为主症，故诊断为月经先期。足三里、脾俞、太冲用于肝郁脾虚证的治疗（A错）。命门、三阴交、足三里可用于经迟虚寒证的治疗（B错）。月经先期即经早，选取关元、气海、血海、三阴交为主穴，以清热和血，益气调经（C对）。气海、三阴交、归来为经迟的主穴，能温经散寒，和血调经（D错）。关元、三阴交、肝俞为经乱的主穴，能疏肝益肾，调理冲任（E错）。